某地高血压的患病率约为20%，抽样调查时至少需调查人数为（设α＝0.05，d＝0.1p）
A. 1600
B. 2000
C. 3600
D. 4000
E. 5000

正确答案：A。1600

解析：本题考查样本量的计算，根据题意可得p＝0.2，q＝1－p＝0.8，由α＝0.05，d＝0.1p可得，样本量n＝400×q/p＝400×0.8/0.2＝1600（A对BCDE错）。